女性恒牙龋均高于男性是因为
A. 女性爱吃零食
B. 男性卫生习惯好
C. 女性恒牙萌出早
D. 牙釉质抗龋性差
E. 牙齿再矿化能力差

正确答案：C。女性恒牙萌出早

解析：关于性别与龋病的关系，目前尚无明确的定论，大多数调查显示乳牙患龋率男性略高于女性，而恒牙患龋率女性略高于男性。主要由于女性在生理上发育早于男性，故女性的乳牙脱落和恒牙萌出均早于男性，即女性恒牙接触口腔环境的时间以及受到龋病侵蚀的可能均早于男性之故。掌握“龋病流行病学”知识点。